患者大便不通1周，伴腹中胀痛，胸胁痞满，苔薄腻，脉弦，治疗应选
A. 大肠的募穴足阳明足少阳经穴
B. 大肠的背俞穴手阳明经穴
C. 大肠的背俞穴募穴及下合穴
D. 大肠的下合穴足阳明经穴
E. 大肠的募穴足阳明足太阴经穴

正确答案：C。大肠的背俞穴募穴及下合穴

解析：患者大便不通1周，诊为便秘，伴腹中胀痛，胸胁痞满，苔薄腻，脉弦，为气秘，属实证，治宜调理肠胃，行滞通便。脏腑之气输注于背腰部的腧穴，称为背俞穴；脏腑之气汇聚于胸腹部的腧穴，称为募穴；六腑之气下合于下肢足三阳经的腧穴，称为下合穴。取背俞穴、募穴及下合穴意在疏通脏腑之气，行滞通便（C对）。